可用作气雾剂抛射剂的物质是
A. 丙二醇
B. 司盘60
C. 亚硫酸钠
D. 二氯二氟甲烷
E. 尼泊金乙酯

正确答案：C。亚硫酸钠